8名高血压患者用药治疗后舒张压下降数为（mmHg）：8、20、-4、16、12、20、10、10，经t检验结论为：（t（0.05，7））=1.895）
A. t=5.15，P0.05
B. t=4.19，P0.05
C. t=0.92，P0.05
D. t=1.67，P0.05
E. t=3.62，P0.05

正确答案：B。t=4.19，P0.05

解析：本题是配对t检验，首先建立假设：
H0：μd＝0，该药治疗无效果
H1：μd≠0，该药治疗有效果
双侧α＝0.05
令n＝8，∑（）d2＝（82＋202＋42＋162＋122＋202＋102＋102）＝1480，∑d＝92，均数＝∑（）d／n＝（8＋20－4＋16＋12＋20＋10＋10）／8＝11.5
因为t＝4.19t（0.05，7）＝1.895，所以P0.05。掌握“定量资料的统计描述和推断”知识点。